分子结构中有“连二烯醇”结构单元
A. 维生素E
B. 维生素C
C. 两者均有
D. 两者均无

正确答案：B。维生素C

解析：本题考查具有“连二烯醇”结构的药物。“连二烯醇”结构指的是乙烯基的两个碳上分别连有一个醇羟基，故称为“连二烯醇”，维生素C（B对）分子中含有连二烯醇结构，极易氧化，氧化过程较为复杂。维生素E含有苯并二氢吡喃结构（ACD错）。